下列疾病中好发于下颌第二双尖牙的是
A. 畸形中央尖
B. 畸形舌侧窝
C. 畸形根面沟
D. 畸形舌侧尖
E. 釉珠

正确答案：A。畸形中央尖

解析：本题考查畸形中央尖。畸形中央尖多见于下颌第二前磨牙，常呈对称分布，一般均位于（牙合）面中央窝，呈圆锥形突起（A对）。牙内陷在临床上可分为畸形舌侧窝（B错）、畸形舌侧尖（D错）、畸形根面沟（C错）、牙中牙，常见于上颌侧切牙。釉珠多发生在磨牙（E错）。